关于手的骨间肌，正确的是
A. 第2骨间掌侧肌止于中指桡侧
B. 第4骨间背侧肌止于小指桡侧
C. 屈掌指关节，伸手指关节
D. 第3骨间背侧肌止于第4指桡侧
E. 无上述情况

正确答案：C。屈掌指关节，伸手指关节

解析：第2骨间掌侧肌止于第2指指背腱膜，而非中指桡侧（A错），第4骨间背侧肌止于第4指指背腱膜，而非小指桡侧（B错），屈掌指关节，伸指间关节（C对），第3骨间背侧肌止于第4指指背腱膜，而非第4指桡侧（D错）。